正常足月胎儿的脐带长度平均为
A. 25cm
B. 35cm
C. 55cm
D. 85cm
E. 90cm

正确答案：C。55cm

解析：妊娠足月胎儿的脐带长30～100cm，平均约55cm，直径0.8～2.0cm，表面有羊膜覆盖呈灰白色。掌握“妊娠生理”知识点。